肾细胞癌最常见的组织病理类型是
A. 乳头状肾细胞癌
B. 未分化肾细胞癌
C. 嫌色细胞癌
D. 集合管癌
E. 透明细胞癌

正确答案：E。透明细胞癌

解析：肾细胞癌最常见的组织病理类型是透明细胞癌（E对）。其他病理类型有嗜色细胞癌或称乳头状肾细胞癌（A错）、嫌色细胞癌（C错）、肾集合管癌（D错）和未分化肾细胞癌（B错）（P563）。